下列各项中，与心悸并犯对诊断心肾阳虚证最有意义的是
A. 肢体水肿，畏寒神疲
B. 胸闷气喘，唇甲青紫
C. 舌质紫暗，脉象细涩
D. 胸闷气短，腰膝酸软
E. 四肢抽搐，角弓反张

正确答案：A。肢体水肿，畏寒神疲

解析：心肾阳虚，鼓动无力，常出现心悸；阳虚则寒，形体失于温养，脏腑功能衰退，则腰膝酸软，形寒肢冷；肾阳亏虚，蒸腾气化失司，三焦决渎不利，水湿内停，外溢肌肤，故肢体浮肿，小便不利；阳气不振，推动无力，机能衰退，则神疲乏力，精神萎靡甚则嗜睡。与心悸合并诊断心肾阳虚者当有肾阳虚的表现，肢体水肿，畏寒神疲为心肾阳虚的表现（A对），胸闷气喘，唇甲青紫为气滞血瘀、心脉瘀阻的表现（B错），舌质紫暗，脉象细涩为瘀血表现（C错），胸闷气短，腰膝酸软者肾气虚（D错），四肢抽搐，角弓反张为肝阳化风的表现（E错）。